患者食欲和记忆力减退，查体：眼睑苍白，血红细胞、白细胞和血小板均减少。应首先考虑的是
A. 再生障碍性贫血
B. 缺铁性贫血
C. 溶血性贫血
D. 失血性贫血
E. 巨幼红细胞性贫血

正确答案：A。再生障碍性贫血

解析：本例患者眼睑苍白，血象结果为血红细胞、白细胞和血小板三系均减少，诊断应首先考虑的是再生障碍性贫血（A对），患者食欲和记忆力减退可能是由贫血所引起的。缺铁性贫血（B错）主要是由机体缺铁和铁利用障碍引起，有乏力等贫血表现和口腔炎等组织缺铁表现，血象呈小细胞低色素性贫血，白细胞和血小板计数一般正常。溶血性贫血（C错）主要是由红细胞破坏超过骨髓的代偿能力所引起，血象结果常为成熟红细胞减少，网织红细胞比例升高，白细胞和血小板计数可不受影响。失血性贫血（D错）主要是由急性或慢性失血所引起，血象结果常为红细胞减少，网织红细胞比例升高，白细胞和血小板计数可不受影响。巨幼红细胞性贫血（E错）主要是由叶酸或维生素B12缺乏所引起，血象呈大细胞性贫血，成熟红细胞减少，网织红细胞计数可正常，白细胞和血小板计数可不受影响。